男，58岁，咳嗽、咳痰，痰中带血，既往肺门肿物，现支气管镜右肺上叶尖端新生物，治疗
A. 肺叶切除
B. 肺段切除
C. 袖状切除
D. 全肺切除
E. 楔形切除

正确答案：A。肺叶切除

解析：患者男，58岁，既往肺门肿物，出现咳嗽、咳痰，痰中带血等表现，现支气管镜右肺上叶尖端新生物，结合患者的年龄（肺癌男性多见，好发年龄在55-65岁），表现(咳嗽、咳痰，痰中带血)，辅检(支气管镜右肺上叶尖端新生物)，考虑为肺癌，手术治疗是最佳的治疗方法，行肺叶切除，如果不能耐受肺叶切除的病人也可考虑行楔形切除（A对E错）。